有关肺循环血管说法正确的是
A. 肺动脉干起自右心室
B. 肺动脉内流动着动脉血
C. 肺静脉2条汇入左心房
D. 肺静脉内含静脉血
E. 以上全不对

正确答案：A。肺动脉干起自右心室

解析：肺动脉干起自右心室（A对）。肺动脉干及其分支输送静脉血（B错）。肺静脉内含动脉血（D错）。左、右肺各汇成二条（C错）肺静脉注入左心房。